根尖周囊肿的诊断要点如下，除外
A. X线片根尖周透射区周边白线围绕
B. 牙髓活力正常，不松动
C. 破坏区周围有新生骨质增生
D. 镜下见胆固醇结晶
E. 大囊肿可使邻牙被压迫移位和根吸收

正确答案：B。牙髓活力正常，不松动

解析：当根尖周组织发生化脓性病变时（根尖周肉芽肿一根尖周脓肿），脓腔的表面就可由牙周膜内遗留的上皮剩余细胞增殖、铺满，形成囊壁。随着囊腔中渗透压的增高，组织液渗入成为囊液，小囊腔逐渐扩大或相互融合形成根尖周囊肿。囊液内因含有含铁血黄素而呈浅褐色，清澈透明，上皮细胞变性分解所产生的胆固醇结晶飘浮于囊液中，使囊液在光照下闪耀发亮。用显微镜观察囊液涂片，可见其中有许多菱形或长方形的胆固醇结晶。囊肿周围的牙槽骨受压迫而被吸收，同时在破坏区周围有新生骨质增生。由于根管内病原刺激物持续存在，根尖周囊肿可继发感染，并发化脓性炎症而转为根尖周脓肿。根尖周囊肿为根尖周圆形透射区（豌豆大至鸡蛋大），有阻射的白线围绕。掌握“慢性根尖周炎”知识点。